成釉细胞瘤为“临界瘤”的主要原因是
A. 来源于牙源性上皮
B. 长得特别大
C. 瘤体内牙根吸收
D. 有局限性浸润生长
E. 压迫三叉神经引起相应部位麻木

正确答案：D。有局限性浸润生长

解析：临床上依照肿瘤的生物学行为将肿瘤分为良性肿瘤和恶性肿瘤，但良性肿瘤与恶性肿瘤的区别是相对的，有的肿瘤病程虽长，但有局部浸润，其生物学行为介于良性和恶性之间的，称为临界瘤，如唾液腺多形性腺瘤、成釉细胞瘤。掌握“成釉细胞瘤”知识点。